患者两臂酸痛或抽掣，不得上举，两手麻木，舌苔白腻，脉弦滑，治宜选用
A. 茯苓丸
B. 定痫丸
C. 地黄饮子
D. 补阳还五汤
E. 独活寄生汤

正确答案：A。茯苓丸

解析：患者两臂酸痛或抽掣，不得上举，两手麻木，是双臂经络受阻，脉络失养的症状；舌苔白腻，脉弦滑提示体内有痰湿；故此人为痰湿内盛，流注于双臂经络，治宜用茯苓丸燥湿行气，软坚化痰（A对）。定痫丸（B错）的功用为涤痰息风，清热定痫。主治：痰热痫证。地黄饮子（C错）的功用为滋肾阴，补肾阳，开窍化痰。主治：喑痱。补阳还五汤（D错）的功用为补气活血通络。主治：气虚血瘀之中风。独活寄生汤（E错）的功用为祛风湿，止痹痛，益肝肾，补气血。主治：痹证日久，肝肾两虚，气血不足证。